免疫耐受是一种特殊形式的免疫应答具有
A. 特异性
B. 耐受性
C. 拮抗性
D. 聚集性
E. 以上说法均正确

正确答案：A。特异性

解析：免疫耐受是指抗原特异性的免疫无应答。对某种抗原产生免疫耐受的个体，对其他抗原可保持正常的免疫应答能力。免疫耐受是一种特殊形式的免疫应答，它由抗原诱生，具有特异性和记忆性。掌握“免疫耐受”知识点。